淋病的主要传播途径是经
A. 血液传播
B. 虫媒传播
C. 消化道传播
D. 性接触传播
E. 呼吸道传播

正确答案：D。性接触传播